苯中毒时可见
A. 皮肤呈樱桃红色
B. 皮肤呈古桐色
C. 皮肤角化过度
D. 皮肤溃疡或痤疮
E. 皮肤脱脂而干燥

正确答案：E。皮肤脱脂而干燥

解析：本题考查苯对皮肤的影响。当机体经常接触苯时，皮肤可脱脂变干燥（E对ABCD错）、脱屑以至皲裂，有的出现过敏性湿疹、脱脂性皮炎等症状。